患者，女，20岁，未婚。经行鼻衄3年，量较多，色红，月经周期提前，经量偏少，经行第2天鼻衄，情绪波动影响出血量，舌质红，脉细弦。治疗应首选
A. 丹栀逍遥散
B. 清肝引经汤
C. 清热固经汤
D. 清肝止淋汤
E. 顺经汤加牛膝

正确答案：B。清肝引经汤

解析：题中患者经行鼻衄3年，故诊断为经行吐衄。肝郁化火，木火炽盛，冲气偏盛，值经前或行经之时，冲气挟肝火上逆，热伤阳络，血随气升所致。火盛故经血量较多，色红。热扰冲任，迫血妄行，故月经周期提前，因衄血量多，故经血量偏少，情绪波动影响肝的疏泄，故影响出血量。舌质红，脉细弦为肝热内盛之象，故辨为肝经郁火证，治宜清肝调经。丹栀逍遥散功能养血健脾，疏肝清热，主治肝郁血虚，内有郁热证，症状多伴阴虚之症（A错）。经行吐衄肝经郁火证治宜清肝调经，方选清肝引经汤（B对）。清热固经汤功能滋阴清热，固经止血，为崩漏血热证之实热证的选方（C错）。清肝止淋汤功能养血清肝，主治妇人血虚火旺，带下色红，似血非血，淋沥不断（D错）。顺经汤加牛膝功能滋阴养肺，为经行吐衄肺肾阴虚证的选方（E错）。